复苏后治疗，保证一切复苏措施奏效最重要的是
A. 维持良好的呼吸功能
B. 确保循环功能的稳定
C. 防治肾功能衰竭
D. 脑复苏
E. 防治感染

正确答案：B。确保循环功能的稳定

解析：维持良好的呼吸功能、确保循环功能的稳定、防治肾功能衰竭、脑复苏、防治感染均为复苏后治疗措施，但其中最重要，能保证一切复苏措施奏效的是确保循环功能的稳定（B对）。因为心脏如果停止了跳动，则自主循环功能无法保证，全身各器官组织均得不到充足血供，就会发生多器官功能障碍综合征。